主要用于青光眼急性发作短期控制的药物是
A. 依他尼酸
B. 依托塞米
C. 布美他尼
D. 乙酰唑胺
E. 氢氯噻嗪

正确答案：D。乙酰唑胺

解析：本题考查药物的适应证。乙酰唑胺（D对）是碳酸酐酶抑制剂，适用于各种类型青光眼急性发作时的短期控制，是一种有效降低眼压的辅助药物，也可应用于继发性青光眼降低眼压。依他尼酸（A错）用于充血性心力衰竭、急性肺水肿、肾性水肿、肝硬化腹水、肝癌腹水、血吸虫病腹水、脑水肿及其它水肿。依托塞米（B错）用于充血性心力衰竭引起的水肿，原发性高血压。布美他尼（C错）用于水肿性疾病如充血性心力衰竭、肝硬化、肾脏疾病；高血压危象；预防急性肾衰竭等。氢氯噻嗪（E错）用于水肿性疾病、高血压，中枢性或肾性尿崩症，肾石症。